我国流行性乙型脑炎的主要传染源是
A. 蚊
B. 猪
C. 犬
D. 蜱
E. 鼠

正确答案：B。猪

解析：猪的感染率高，感染后血中病毒含量多，病毒血症期长，且因猪的饲养面广，更新率高，是本病主要的传染源（B对）。乙脑的主要传播途径是蚊虫叮咬（A错）。我国狂犬病主要传染源是病犬（C错）。鼠类自然感染率很高，是莱姆病主要传染源（E错）。